小儿肾病综合征血瘀证，其治法是
A. 肾上腺皮质激素，加活血化瘀
B. 肾上腺皮质激素，加清热解毒
C. 肾上腺皮质激素，加健脾利水
D. 肾上腺皮质激素，加温肾健脾
E. 环磷酰胺，加清热解毒

正确答案：A。肾上腺皮质激素，加活血化瘀

解析：小儿肾病综合征血瘀证宜活血化瘀。方药：桃红四物汤加减。肾病综合征诊断确定后应尽早选用泼尼松治疗（A对）。上焦湿热，治法：清热解毒燥湿。环磷酰胺有助于延长缓解期及减少复发，改善激素耐药者对激素的效应（BE错）。水湿证宜补气健脾，利水消肿。方药：五苓散合己椒苈黄丸加减（C错）。脾肾阳虚证的治法：温肾健脾，化气行水。方药：偏肾阳虚，真武汤合黄芪桂枝五物汤加减（D错）。